先安未受邪之地属于
A. 治病求本
B. 未病先防
C. 既病防变
D. 因地制宜
E. 因时制宜

正确答案：C。既病防变

解析：既病防变，包括早期诊治和防止传变，防止传变包括：阻截病传途径和先安未受邪之地。“先安未受邪之地”指的是在疾病诊疗的过程中，不但要对病位之所进行诊治，而且还应该根据疾病发展传变的规律，对未受邪而可能即将被传及之处，实现予以充实，阻止病变传至该处，达到中断其发展的目的（C对）。治病求本（A错）是指在治疗疾病时，必须辨析疾病的病因病机，抓住疾病的本质，并针对疾病的本质进行治疗，是整体观念与辨证论治在治疗中的体现。未病先防（B错）属于通过调摄精神，饮食，情志等多方面进行对疾病的预防。因地制宜（D错）指根据不同的地域环境特点，来制定适宜的治疗原则。因人制宜（E错）指根据病人的年龄、性别、体质等不同特点，来制订适宜的治疗原则。